当前我国城市社区一般指
A. 市
B. 企、事业单位
C. 城镇
D. 区
E. 街道、居委会

正确答案：E。街道、居委会

解析：本题考查行政区划分。我国地域型社区是以地理范围为基础，由不同的个体或家庭生活在彼此相邻近的空间，而形成共享公共资源及相互依存的关系，如市（县）、街道（乡镇）、居委会（村）（E对ABCD错）等。当前我国城市社区一般指街道、居委会。